铁的主要食物来源是
A. 动物肝脏
B. 奶及奶制品
C. 蔬菜、水果
D. 豆类
E. 粮谷类

正确答案：A。动物肝脏

解析：膳食中铁的良好来源主要是动物肝脏、动物全血等。掌握“合理营养指导”知识点。